甲状腺滤泡状癌行甲状腺切除术后复发
A. 血清甲状腺球蛋白升高
B. 血清降钙素升高
C. 血清甲状旁腺素升高
D. 血清垂体促甲状腺激素升高
E. 血清T3、T4升高

正确答案：A。血清甲状腺球蛋白升高

解析：血清甲状腺球蛋白升高（A对）对监测甲状腺滤泡状癌是否复发具有高度的敏感性和特异性。甲状腺癌复发时常伴随着血清甲状腺球蛋白的升高。降钙素由甲状腺C细胞分泌，术后血清降钙素升高常提示甲状腺髓样癌复发，甲状腺滤泡状癌复发，血清降钙素不升高（B错）。甲状旁腺素由由甲状旁腺分泌，甲状腺滤泡状癌复发，血清甲状旁腺激素不升高（C错）。血清垂体促甲状腺激素升高可促使甲状腺滤泡状癌手术后复发，但甲状腺滤泡状癌手术后复发时，血清垂体促甲状腺激素不一定升高（D错）。甲状腺滤泡状癌行甲状腺切除术后复发，患者甲状腺功能测定一般正常，仅少数患者血清T3、T4轻度升高（E错）。